下列关于肠道杆菌的相关叙述中，不正确的是
A. 呈中等大小的杆状
B. 直径0.3～1.0μm，长1～6μm
C. 革兰氏染色为阴性
D. 多数有菌毛、周鞭毛，少数有荚膜
E. 可形成芽胞

正确答案：E。可形成芽胞

解析：肠道杆菌呈中等大小的杆状，直径0.3～1.0μm，长1～6μm，革兰氏染色为阴性，多数有菌毛、周鞭毛，少数有荚膜，不形成芽胞。掌握“肠道杆菌共性及埃希氏菌属”知识点。